女，40岁，因肋骨肿瘤行肋骨切除，术后病理证实为甲状腺滤泡状腺癌转移，随后检查发现甲状腺右侧下极有直径2cm的肿块，质硬，颈部未发现肿大淋巴结。下一步正确的治疗方案是
A. 右侧甲状腺及峡部切除，左侧甲状腺大部切除，术后行放射性碘治疗
B. 甲状腺全切，术后行放射性碘治疗
C. 外放射治疗，同时口服甲状腺干制剂
D. 甲状腺全切+右侧颈淋巴结清扫，术后行放射性碘治疗
E. 化疗，同时口服甲状腺干制剂

正确答案：B。甲状腺全切，术后行放射性碘治疗

解析：甲状腺肿瘤常用术式包括：①腺叶次全切：适用于诊断为良性疾病，但术后病理诊断为孤立性乳头状癌者；②腺叶+峡部切除：适用于肿瘤直径不大于1.5cm，且局限于一叶者；③甲状腺近全切：适用于肿瘤直径大于1.5cm，一侧乳头状癌伴有颈淋巴结转移者；④甲状腺全切：适用于高度侵袭性乳头状癌、滤泡状癌，明显多灶性，双侧颈淋巴结肿大，肿瘤侵犯颈部组织或有远处转移者；⑤甲状腺全切+患侧颈淋巴结清扫，可用于治疗已有远处转移者。该患者已出现肋骨转移，须行甲状腺全切，且该患者甲状腺癌类型为分化较好的滤泡状癌，其聚碘能力较好，术后可应用放射性碘来治疗远处转移，但腺癌的远处转移只能在切除全部甲状腺后才能摄取放射性碘。分化型滤泡状癌细胞存在TSH受体，TSH可通过其受体促进分化型腺癌的生长，因此病人在手术后应终生服用甲状腺素片，以抑制TSH分泌。综上所述，该患者下一步的正确治疗方案是甲状腺全切+术后行放射性碘治疗（B对）及终生服用甲状腺素片。外放射治疗主要用于未分化型甲状腺癌（C错）。甲状腺滤泡状腺癌对化疗不敏感（E错）。目前多不主张对临床淋巴结阴性病人作预防性颈淋巴结清扫（D错）。